女，30岁，初产妇。孕期检查无异常。妊娠35周自然分娩后第2天，母婴分离，乳房胀痛，无红肿，体温37.1℃，要求继续母乳喂养。首选的处理方法是
A. 少喝水
B. 按时挤奶
C. 生麦芽煎服
D. 抗生素治疗
E. 芒硝外敷

正确答案：B。按时挤奶

解析：30岁初产妇，自然分娩后2天，乳房胀痛，无红肿、发热等症状，排除乳腺感染，母婴分离，考虑乳汁淤积导致乳房过度充盈引起乳房胀痛。因产妇要求继续母乳喂养，故需要排空乳房，按时挤奶，以免发生退奶（B对）。哺乳期妇女应多补水（A错）。哺乳期妇女不宜煎服生麦芽、芒硝外敷（CE错）。急性乳腺炎往往发生在产后1周，需抗生素治疗（D错）。